急性心肌梗死发病后12天血清检查仍可能高于正常的指标是
A. 肌酸磷酸激酶的同工酶CK-MB
B. 天门冬氨酸氨基转移酶
C. 肌钙蛋白I
D. 肌酸磷酸激酶
E. 肌钙蛋白T

正确答案：E。肌钙蛋白T

解析：肌钙蛋白T起病3～4小时后升高，于24～48小时达高峰，10～14天降至正常，故急性心肌梗死发病后12天血清检查仍可能高于正常的指标是肌钙蛋白T（E对）。肌钙蛋白I（C错）起病3～4小时后升高，于11～24小时达高峰，7～10天降至正常。肌酸磷酸激酶的同工酶CK-MB（A错），在起病后4小时内增高，16～24小时达高峰，3～4天恢复正常。天门冬氨酸基转移酶亦或称天冬氨酸氨基转移酶（AST），旧称谷草转氨酶（GOT）。肌酸激酶（CK）也称为肌酸磷酸激酶（CPK）（九版诊断学P388）。天门冬氨酸基转移酶（B错）和肌酸磷酸激酶（D错）特异性及敏感性均不如肌钙蛋白、CK-MB等心肌坏死标记物，已不再用于诊断AMI。